对奎宁的叙述哪项错误
A. 最早用于治疗疟疾的药物
B. 对红细胞内期滋养体有杀灭作用
C. 主要用于耐氨喹或耐多药的恶性疟
D. 每周服药1次，用于病因性预防
E. 可出现心肌抑制作用

正确答案：D。每周服药1次，用于病因性预防